得出的统计值可以反映各污染物的平均水平及其离散程度、超标倍数和频率、浓度的时空变化等的方法是
A. 数理统计法
B. 模糊综合评判法
C. 密切值法
D. 环境质量指数法
E. 灰色聚类法

正确答案：A。数理统计法

解析：本题考查数理统计法。数理统计法（A对BCDE错）是通过对原始监测数据的整理分析，可以获得环境质量的空间分布及其变化趋势，所得到的统计值可以反映各污染物的平均水平及其离散程度、超标倍数和频率、浓度的时空变化等。